关于滴眼剂的正确使用，下述错误的是
A. 使用前需清洁双手
B. 将药液滴入下眼袋内，每次1～2滴
C. 滴眼后轻轻闭眼1～2分钟
D. 如同时使用两种眼药水，宜间隔10分钟
E. 两眼同时患病时，先滴病情重者，后滴病情轻者

正确答案：E。两眼同时患病时，先滴病情重者，后滴病情轻者

解析：本题考查滴眼剂的使用。两眼同时患病时，先滴病情轻的眼，后滴病情重的眼（E错，为本体正确答案）。滴眼剂一般先滴右眼、后滴左眼，以免用错药；但如左眼病较轻，应先左后右，以免交叉感染。滴眼剂应用时应注意：清洁双手（A对），将头部后仰，眼向上望，用食指轻轻将下眼睑拉开成一钩袋状。将药液从眼角侧滴入眼袋内，一次滴1～2滴（B对）。③滴后轻轻闭眼1～2min（C对）。若同时使用2种药液，宜间隔10min（D对）。